根据中医理论，属于反治法的有
A. 寒因寒用
B. 寒者热之
C. 通因通用
D. 热者寒之
E. 热因热用

正确答案：A、C、E。寒因寒用；通因通用；热因热用

解析：本题考查的是反治。根据中医理论，属于反治法的有寒因寒用（A对）、通因通用（C对）与热因热用（E对）。反治，又称从治，是指顺从疾病证侯的外在假象而治的治疗法则。适用于临床表现与疾病证候本质不完全一致的病症。反治，主要包括热因热用、寒因寒用、塞因塞用、通因通用四种治法。正治，又称逆治，是指采用方药的性质与疾病的证候性质相反的治疗法则。适用于临床表现与疾病证候本质相一致的病证。常用的治法有寒者热之（B错）、热者寒之（D错）、虚则补之、实则泻之等。